男，34岁。因反复干咳、咯血2月，发热1周来院门诊。查体：T39.2℃，消瘦，左上肺语颤增强，叩诊呈实音呼吸音减弱。WBC7.8×10⁹/L，PPD（1结素单位）强阳性，X线胸片示左上肺大片云雾状密度较低边缘模糊之阴影。最可能的诊断是
A. 肺炎球菌肺炎
B. 干酪性肺炎
C. 支原体肺炎
D. 克雷伯杆菌肺炎
E. 支气管扩张症

正确答案：B。干酪性肺炎

解析：患者青年男性，反复干咳咯血2月，发热1周，查体：T39.2℃（正常腋温36～37℃，患者高热），消瘦，左上肺语颤增强，叩诊呈实音呼吸音减弱。WBC7.8×10⁹/L（正常值4～10×10⁹/L，排除细菌感染），PPD（1结素单位）强阳性（提示结核分枝杆菌感染），X线胸片示左上肺大片云雾状密度较低边缘模糊之阴影（干酪性肺结核的典型胸片改变）。结合患者病史、体征及实验室检查，考虑干酪性肺炎可能（B对）。肺炎球菌肺炎（P46）（A错）虽有高热、咳嗽咳痰、肺实变等，但多有上呼吸道前驱症状，急性发作，全身症状重且白细胞增多，多有核左移现象，自然病程2周左右等特点。支原体肺炎（P49）（C错）除有病程较长、发热咳嗽等特点外，无明显肺部体征、X线示肺部浸润影以肺下叶为主。克雷伯杆菌肺炎（D错）多见于老年人、咳砖红色胶冻样痰，白细胞增多，核左移。支气管扩张症（P37）（E错）典型的症状有慢性咳嗽、咳大量脓痰和反复咯血，X线片示典型的“双轨征”。